使药物分子水溶性增加的结合反应有
A. 与氨基酸的结合反应
B. 乙酰化结合反应
C. 与葡糖醛酸的结合反应
D. 与硫酸的结合反应
E. 甲基化结合反应

正确答案：A、C、D。与氨基酸的结合反应；与葡糖醛酸的结合反应；与硫酸的结合反应

解析：本题考查药物化学结构与第Ⅱ相生物转化的规律。第二相生物转化反应中，氨基酸（A对）、葡萄糖醛酸（C对）、硫酸盐（D对）等内源性小分子可以与药物分子或第Ⅰ相的药物代谢产物结合，增加药物分子水溶性，有利于药物的排泄。乙酰化反应（B错）是体内的氨基反应生成酰胺，而酰胺水溶性小于氨基。甲基化反应（E错）结合甲基，降低药物分子的极性和亲水性，只有叔胺化合物甲基化后生成季铵盐，药物分子水溶性才会提高。